医生的特殊干涉权不是针对
A. 拒绝治疗的住院精神病患者
B. 要求义诊的患者
C. 需要隔离而拒绝隔离的传染病患者
D. 有意抚乱正常医疗秩序的患者
E. 实施自杀行为的抑郁症患者

正确答案：B。要求义诊的患者

解析：医生的特殊干涉权适用范围：①精神病患者或自杀未遂等拒绝治疗（A对）时，甚至病人想要或正在自杀时（E对）；②对需要进行隔离治疗的传染病病人的隔离（C对）；③有意扰乱正常医疗秩序的患者（D对）；④在进行试验性治疗时，虽然病人已知情同意，一旦出现高度危险情况时，医生必须中止试验性治疗，以保护病人的利益；⑤危重病人要求了解自己疾病的真相，一旦了解可能产生不良影响，医生有权隐瞒真相。要求义诊的患者不是医生的特殊干涉权适用范围（B错，为本题正确答案）。